以下哪项不是伤寒穿孔的的首选疗法
A. 穿孔修补和腹腔引流手术
B. 进行肠切除
C. 予抗生素以控制感染
D. 吸除腹腔内凹陷和隐窝可能残存的脓汁
E. 腹腔冲洗

正确答案：B。进行肠切除

解析：对于伤寒局限性穿孔治疗，应根据病情采取治疗，情况较好则不必首选进行肠切除（B错，为本题正确答案）；伤寒穿孔应及时行穿孔修补和腹腔引流手术（A对），引流出游离液体；肠穿孔应予抗生素以控制感染（C对），警惕感染性休克的发生；吸出腹腔内凹陷和隐窝可能残存的脓汁（D对），进行腹腔冲洗（E对）保持腹腔清洁，防止感染。